对幽门螺杆菌有强大杀菌作用的是
A. 阿莫西林
B. 青霉素G
C. 红霉素
D. 奥美拉唑
E. 氨苄西林

正确答案：A。阿莫西林

解析：阿莫西林的抗菌作用及临床应用：抗菌谱和抗菌活性与氨苄西林相似，但对肺炎球菌、肠球菌、沙门菌属、幽门螺杆菌的杀菌作用比氨苄西林强。主要用于敏感菌所致的呼吸道、尿路、胆道感染以及伤寒治疗。此外，也可用于慢性活动性胃炎和消化性溃疡的治疗。掌握“青霉素及头孢菌素类药”知识点。